使用抗组胺药物治疗药物过敏性口炎，正确的方法是
A. 成人可选用口服氯雷他定10mg，每日1次
B. 成人可选用口服氯雷他定10mg，每日2次
C. 成人马来酸氯苯那敏4～8mg，每日2次
D. 成人马来酸氯苯那敏4～8mg，每日1次
E. 小儿可选用口服氯雷他定10mg，每日3次

正确答案：A。成人可选用口服氯雷他定10mg，每日1次

解析：口服抗过敏药物，内服抗组胺类药物，成人可选用口服氯雷他定10mg，每日1次；马来酸氯苯那敏4～8mg，每日3次等。小儿用量应参考药物说明书。掌握“血管神经性水肿”知识点。